休克时最常出现的酸碱失衡是
A. 代谢性碱中毒
B. AG升高性代谢性酸中毒
C. 呼吸性酸中毒
D. AG正常性代谢性酸中毒
E. 呼吸性碱中毒

正确答案：B。AG升高性代谢性酸中毒

解析：休克时的微循环障碍及组织缺氧，使线粒体氧化磷酸化受抑，葡萄糖无氧酵解增强及乳酸生成增多。同时，由于肝功能受损不能将乳酸转化为葡萄糖，肾功能受损不能将乳酸排除，结果导致高乳酸血症及代谢性酸中毒,所以AG（阴离子间隙）升高性代谢性酸中毒（B对ACDE错）是休克时最常出现的酸碱失衡。